下列除哪项外，均符合问诊的要求
A. 态度和蔼，言语亲切
B. 要将患者陈述的内容去粗取精，去伪存真
C. 交谈时避免使用特定意义的医学术语
D. 医生要多提出诱导性的问题
E. 对危重患者只扼要询问，待病情缓和后再补充

正确答案：D。医生要多提出诱导性的问题

解析：问诊是医师通过对患者或相关人员的系统询问获取病史资料，经过综合分析而作出临床判断的一种诊法，其要求有：①医师要态度和蔼，言语亲切（A对）。②医师要将患者陈述的内容去粗取精，去伪存真（B对）。③交谈时避免使用特定意义的医学术语（C对）。④对危重患者只扼要询问，待病情缓和后再补充（E对）。⑤要避免提出诱导性的问题（D错，为本题正确答案）。